患者，女，45岁。因急腹症入院，诊断为化脓性胆囊炎穿孔并发绿脓杆菌性腹膜炎。既往有青霉素过敏史。抗感染治疗应选用
A. 羟苄青霉素
B. 头孢氨苄
C. 红霉素
D. 氯林可霉素
E. 环丙沙星

正确答案：E。环丙沙星

解析：环丙沙星（E对）抗菌谱广，对革兰氏阴性杆菌抗菌活性强，对一些革兰氏阳性球菌亦有较强的抗菌活性，对铜绿假单胞菌（又称为绿脓杆菌）、肠球菌、肺炎链球菌、葡萄球菌、军团菌、淋病奈瑟菌及流感杆菌的抗菌活性高，临床主要用于敏感菌所致的呼吸道、泌尿系、消化道、皮肤软组织的感染及胆囊炎、胆管炎、中耳炎、副鼻窦炎、淋球菌性尿道炎等。羟苄青霉素、头孢氨苄均属于β₂-内酰胺类抗生素，其中羟苄青霉素（A错）对产酶的金黄色葡萄球菌和绿脓杆菌无效；头孢氨苄（B错）对革兰阴性菌作用差，对绿脓杆菌无效。红霉素（C错）对金黄色葡萄球菌、链球菌、肺炎球菌、白喉杆菌等较敏感，对部分革兰性阴性菌如脑膜炎球菌、淋球菌、流感杆菌、百日咳杆菌等有效，对绿脓杆菌作用较弱。氯林可霉素（D错）对葡萄糖球菌、各型链球菌、肺炎球菌等革兰阳性菌均具有强大的抗菌作用，对绿脓杆菌作用弱。